DIC时产生的贫血属于：
A. 再生障碍性贫血
B. 失血性贫血
C. 中毒性贫血
D. 微血管病性溶血性贫血
E. 缺铁性贫血

正确答案：D。微血管病性溶血性贫血

解析：微血管病性溶血性贫血（D对ABCE错）是DIC 患者产生的贫血。